内痔的早期症状是
A. 排便时疼痛
B. 内痔脱出
C. 里急后重
D. 肛门瘙痒
E. 排便时出血

正确答案：E。排便时出血

解析：内痔是肛垫的支持结构、静脉丛及动静脉吻合支发生病理性改变或移位。内痔分四度，早期属第Ⅰ度，在第Ⅰ度中只会表现排便时滴血（E对）。内痔主要表现为出血和脱出，一般无肛门疼痛（A错）。痔核脱出（B错）在内痔中晚期（Ⅱ度、Ⅲ度、Ⅳ度）出现。内痔无里急后重（C错）等直肠刺激症状。肛门瘙痒属于外痔症状（D错），内痔一般无此表现。